病毒性心肌炎气虚血滞证的用方是
A. 银翘散
B. 附子汤
C. 葛根芩连汤
D. 生脉散合复脉汤
E. 血府逐瘀汤合生脉散

正确答案：E。血府逐瘀汤合生脉散

解析：病毒性心肌炎气虚血滞证是由于心气不足，血行无力，血流不畅所致，故治疗时应益气活血，调心复脉，首选血府逐瘀汤合生脉散（E对）。银翘散（A错）其功用为辛凉透表，清热解毒，适用于病毒性心肌炎之风热犯心证。附子汤（B错）其功用为温经助阳，祛寒化湿，适用于肾阳虚衰兼水湿泛滥之证。葛根芩连汤（C错）其功用为解表清里，适用于病毒性心肌炎之湿热侵心证。生脉散合复脉汤（D错），生脉散的功用为益气生津，敛阴止汗，复脉汤的功用为益气滋阴，通阳复脉，二者合用，适用于病毒性心肌炎之气阴亏虚证。